有关表面活性剂的正确表述是
A. 表面活性剂的浓度要在临界胶团浓度（CMC）以下，才有增溶作用
B. 表面活性剂用作乳化剂时，其浓度必须达到临界胶团浓度
C. 非离子表面活性剂的HLB值越小，亲水性越大
D. 表面活性剂均有很大毒性
E. 阳离子表面活性剂具有很强杀菌作用，故常用作杀菌和防腐剂

正确答案：E。阳离子表面活性剂具有很强杀菌作用，故常用作杀菌和防腐剂

解析：本题考查表面活性剂。阳离子表面活性剂具有很强杀菌作用，故常用作杀菌和防腐剂（E对）；表面活性剂浓度到达临界胶团浓度时仍具有增溶作用（A错）；某些表面活性剂作乳化剂时与浓度无关（B错）；HLB值越小，亲油性越大（C错）；非离子表面活性剂的毒性较轻微（D错）。